重症肝炎产妇产后出血的常见原因是
A. 子宫收缩乏力
B. 软产道裂伤
C. 胎盘粘连
D. 胎盘残留
E. 凝血功能障碍

正确答案：E。凝血功能障碍

解析：重症肝炎导致肝功能下降，肝脏中的凝血因子合成减少，从而使凝血功能障碍（E对），引起产后出血。分娩后，子宫肌纤维的收缩和缩复使胎盘剥离面迅速缩小，同时使周围的螺旋动脉得到生理性结扎，从而控制出血，子宫收缩乏力（A错）时不能很好的控制出血；软产道裂伤（B错）后，尤其未及时发现，可导致产后出血；胎盘粘连（C错）导致子宫收缩不良，已剥离面血窦开放发生出血；胎盘残留（D错）会影响子宫收缩而出血。上述四个选项皆可导致孕妇产后出血，但与重型肝炎关系不大。